缺铁性贫血最可靠的诊断依据是
A. 网织红细胞减少
B. MCV降低
C. 骨髓中铁粒幼红细胞减少
D. 血清铁降低
E. 骨髓象和红细胞系增生低下

正确答案：C。骨髓中铁粒幼红细胞减少

解析：缺铁性贫血（P541）是由于机体对铁的需求与供给失衡导致体内贮存铁耗尽，继之红细胞内铁缺乏引起的贫血。诊断缺铁性贫血最可靠的依据是贮存铁减少，即血清铁蛋白降低、骨髓铁染色显示骨髓小粒可染铁消失，铁粒幼红细胞减少（C对）；缺铁性贫血时，血象呈小细胞低色素性贫血（MCV降低、MCH降低、MCHC降低），网织红细胞计数多正常或轻度增高（A错），骨髓象增生活跃或明显活跃，以红系增生为主（E错）；MCV降低（B错）提示小细胞低色素性贫血，除见于缺铁性贫血外，还可见于铁粒幼细胞性贫血、慢性病性贫血、海洋性贫血等，不具有特异性；血清铁降低（D错）不是缺铁性贫血的敏感和特异性指标，还可见于慢性病性贫血、转铁蛋白缺乏症等。